社区获得性肺炎最常见的致病菌是
A. 肺炎克雷伯杆菌
B. 流感嗜血杆菌
C. 肺炎链球菌
D. 肺炎军团菌
E. 肺炎支原体

正确答案：C。肺炎链球菌

解析：社区获得性肺炎（CAP）是指在医院外罹患的感染性肺实质炎症，包括具有明确潜伏期的病原体感染而在入院后平均潜伏期内发病的肺炎。社区获得性肺炎（CAP）常见的致病菌为肺炎链球菌、支原体（E错）、衣原体、流感嗜血杆菌（B错）和呼吸道病毒等，其中肺炎链球菌所引起的肺炎约占社区获得性肺炎的半数，所以为最常见的致病菌（C对）。肺炎克雷伯杆菌（A错）是医院获得性肺炎常见的致病菌。肺炎军团菌（D错）既不是社区获得性肺炎也不是医院获得性肺炎的常见致病菌。